医疗保健机构依法开展产前诊断的，必须符合卫生部规定的条件和技术标准，并经县级以上地方人民政府卫生行政部门
A. 审查
B. 审核
C. 认可
D. 许可
E. 确认

正确答案：D。许可

解析：本题考查母婴保健法及其实施办法。医疗保健机构依照《母婴保健法》规定开展婚前医学检查、遗传病诊断、产前诊断以及施行结扎手术和终止妊娠手术的，必须符合国务院卫生行政部门规定的条件和技术标准，并经县级以上地方人民政府卫生行政部门许可（D对）。严禁采用技术手段对胎儿进行性别鉴定，但医学上确有需要的除外。